65岁妇女，在地上滑倒，造成股骨近端骨折，下列骨折类型预后最差的是
A. 头下型
B. 经颈型
C. 基底型
D. 粗隆间
E. 粗隆下

正确答案：A。头下型

解析：股骨头血液供应来源有小凹动脉、股骨干滋养动脉升支和旋股内、外侧动脉。骺外侧动脉是旋股内侧动脉的分支，供应股骨头2/3～4/5区域的血液循环，是股骨头最主要的供血来源。股骨头下型骨折（A对）时，骺外侧动脉易发生中断，使得股骨头仅剩小凹动脉的少量血供，故易发生缺血性骨坏死，预后最差。经股骨颈骨折（B错）也可发生股骨头缺血坏死，但发生坏死的几率较头下型低。股骨颈基底骨折（C错）的骨折线位于股骨颈与大小转子间连线处，尚有旋骨内外侧动脉分支吻合的动脉环提供血液循环，故对骨折部血液供应的干扰较小，骨折预后较好。股骨粗隆型（D错）、粗隆下（E错）骨折，位于髋关节囊外，很少破坏支配股骨头的血管，故一般不会发生股骨头坏死，预后较好。